1994年平山县发现喘憋性肺炎的流行，暴露总人口数为83271，经调查诊断发病例数共1478例，试问在资料分析时疾病的频率指标应选用
A. 发病率
B. 罹患率
C. 时点患病率
D. 期间患病率
E. 感染率

正确答案：B。罹患率

解析：本题考查罹患率的概念。流行性喘憋性肺炎是我国独特的流行性肺炎，该病发病急、流行面广、进展快、症状重。本病的特点是：在农村出现明显的暴发流行；具有喘憋和发作性喘憋的特征；具有毛细支气管炎及间质性肺炎的肺部表现；主要侵犯婴幼儿。罹患率的定义是在某一局限范围短时间内的发病率。由于憋喘性肺炎是暴发流行，符合短时间小范围人群的发病率，所以选择罹患率（B对ACDE错）。